始基囊肿属于
A. 胚胎性软组织囊肿
B. 潴留囊肿
C. 牙源性囊肿
D. 面裂囊肿
E. 血外渗性囊肿

正确答案：C。牙源性囊肿

解析：本题考查始基囊肿。始基囊肿与牙的发育有关，属于牙源性囊肿（C对）。始基囊肿发生于成釉器发育的早期阶段，牙釉质和牙本质形成之前，在炎症和损伤刺激后，成釉器的星网状层发生液化、变性，并有液体渗出，蓄积其中而形成囊肿。口腔颌面部的潴留性囊肿（B错）以皮脂腺囊肿较常见，主要是因为腺管口阻塞，腺体分泌物潴留于腺腔内而形成。面裂囊肿（D错）由胚胎发育过程中残留的上皮发展而来，囊肿多发生于青少年，根据不同部位可出现相应的局部症状，有球上颌囊肿、鼻腭囊肿、正中囊肿和鼻唇囊肿。血外渗性囊肿（E错）主要为损伤后引起骨髓内出血、机化、渗出后而形成，与牙组织本身无关，在颌骨囊肿中，以血外渗性囊肿最为少见。